下列有关外耳道的描述,不正确的是
A. 是外耳门至鼓膜的管道
B. 外1／3为软骨部，内2／3为骨部
C. 为一弯曲管道，故作鼓膜检查时，向后上方牵拉耳郭可使外耳道变直
D. 婴儿外耳道短而狭窄，故鼓膜位置近垂直位
E. 内衬以黏膜，且与鼓室黏膜相连续

正确答案：D。婴儿外耳道短而狭窄，故鼓膜位置近垂直位

解析：外耳道是从外耳门至鼓膜的管道（A对）。外耳道外1/3 为软骨部，与耳郭的软骨相延续；内2/3 为骨性部（B对）。外耳道呈弯曲状，检查鼓膜时，成人需将耳郭向后上方牵拉，使外耳道变直，方可窥见（C对）。婴儿因颞骨尚未骨化，其外耳道几乎全由软骨支持，短而直，鼓膜近于水平位（D错，为本题正确答案），检查时须将耳郭拉向后下方。E选项9版教材未明确。